司来吉兰的药理作用是
A. 激动中枢阿片受体
B. 抑制中枢神经系统胆碱酯酶
C. 抑制纹状体单胺氧化酶
D. 阻断中枢神经系统胆碱受体
E. 激动黑质纹状体通路多巴胺受体

正确答案：C。抑制纹状体单胺氧化酶

解析：本题考查司来吉兰的药理作用。司来吉兰是一种选择性作用于MAO-B的单胺氧化酶抑制剂（C对）。低剂量时抑制黑质-纹状体中的MAO-B，而对外周的MAO-A影响很小。在PD早期治疗中，司来吉兰单药治疗，能减慢症状进展。